患儿男，8个月。近1个月面色苍白。患儿系34周早产，生后母乳喂养，未加辅食。查体：皮肤黏膜苍白，心前区可闻及Ⅱ级收缩期吹风样杂音。肝肋下3cm，脾肋下1cm。红细胞3.0x10¹²/L，血红蛋白71g/L。外周血涂片示红细胞形态大小不等，以小细胞为主，中央变淡。该患儿最可能的诊断是
A. 营养性巨幼细胞贫血
B. 再生障碍性贫血
C. 溶血性贫血
D. 营养性缺铁性贫血
E. 珠蛋白生成障碍性贫血

正确答案：D。营养性缺铁性贫血

解析：本题考查贫血鉴别诊断。该患儿查体结果为皮肤黏膜苍白、心脏杂音、肝脾大等贫血的临床表现，同时血红蛋白降低，不难做出贫血的诊断，其次从红细胞形态大小不等、以小细胞为主，中央变淡等这些形态特点可进一步诊断为营养性缺铁性贫血（D对）。而且该患儿为早产儿，先天储存铁不足，加之未及时添加辅食，从病史上也支持营养性缺铁性贫血的诊断。营养性巨幼细胞贫血（A错）是由于缺乏维生素B₁₂或（和）叶酸所引起的一种大细胞性贫血。再生障碍性贫血（B错）是一种由多种原因引起的骨髓衰竭综合征，临床上常表现为二系或全血细胞减少而肝、脾、淋巴结不肿大为特征。溶血性贫血（C错）是由于红细胞破坏速率增加（寿命缩短），超过骨髓造血的代偿能力而发生的贫血。珠蛋白生成障碍性贫血（E错）又称地中海贫血，是一组遗传性溶血性贫血疾病。